慢性苯中毒可出现
A. 巨幼红细胞性贫血
B. 再生障碍性贫血
C. 溶血性贫血
D. 低色素性贫血
E. 缺铁性贫血

正确答案：B。再生障碍性贫血